下列哪项不属于滑脉所主病证
A. 痰饮
B. 食滞
C. 实热
D. 疟疾
E. 恶阻

正确答案：D。疟疾

解析：弦脉，因肝主疏泄，调畅气机，以柔和为贵。邪气滞肝，疏泄失常，气机不利，脉气紧张所致，故主肝胆病，诸痛，痰饮，疟疾。疟疾不见滑脉（D错，为本题正确答案）。滑脉，因痰湿留聚、食积饮停，邪气充渍脉道，鼓动脉气所致，故主痰饮、食滞、实热、恶阻（ABCE错）。